没药粉末遇硝酸应呈
A. 白色
B. 黄棕色
C. 紫色
D. 深绿色
E. 蓝色

正确答案：C。紫色

解析：本题考查的是没药的理化鉴别。没药粉末遇硝酸应呈紫色（C对）。没药【理化鉴别】取本品与水共研形成黄棕色乳状液。粉末遇硝酸呈紫色。本品粉末乙醚滤液置蒸发皿中挥尽后，残留的黄色液体滴加硝酸，显褐紫色。本品粉末加香草醛试液数滴，天然没药立即显红色，继而变为红紫色；胶质没药立即显紫红色，继而变为蓝紫色。